环境污染的特征是
A. 影响范围大，作用时间长
B. 影响人群面广
C. 多种物质联合作用
D. 环境污染一旦形成，消除很困难
E. 以上都是

正确答案：E。以上都是

解析：本题考查环境污染的特征。由于自然的或人为的原因，进入环境的污染物数量超过环境的自净能力，造成环境质量下降和恶化直接或间接影响人体健康，称为环境污染。其特征是：影响范围大，作用时间长；影响人群面广；多种物质联合作用；环境污染一旦形成，消除很困难（E对ABCD错）。